不存在于微粒体的氧化酶系是
A. 细胞色素P450
B. FAD氧化酶
C. 辅酶Ⅱ-细胞色素P450还原酶
D. 黄嘌呤氧化酶
E. 细胞色素b5

正确答案：D。黄嘌呤氧化酶